患者，男性，35岁。左下第一磨牙拔除5个月，拟行种植义齿修复。选择最佳的种植体为
A. 牙内骨内种植体
B. 黏膜内种植体
C. 穿下颌种植体
D. 两段式种植体
E. 骨内种植体

正确答案：E。骨内种植体

解析：至今临床主要应用的是用骨内种植体，外形多为柱状或螺旋柱状及根形锥状，表面均进行了粗化处理。掌握“牙种植手术及效果评估”知识点。